与肝血管肉瘤发病有关的生产过程是
A. 煤焦油生产
B. 鞋制作
C. 联苯胺制造
D. 品红制造
E. 氯乙烯生产

正确答案：E。氯乙烯生产